溶媒极性最强的是
A. 乙醇
B. 乙烷
C. 乙醚
D. 乙酸乙酯
E. 氯仿

正确答案：A。乙醇

解析：本题考查的是常见溶剂的极性排列。溶媒极性最强的是乙醇（A对）。常用溶剂的极性大小的排列顺序由强到弱为：水、甲醇、乙醇、乙酸乙酯（D错）、三氯甲烷（氯仿）（E错）、乙醚（C错）（无水）、苯、己烷。乙烷（B错）仅含烷基，故极性很弱。